某厂工人经常接触职业性有害因素。该地医疾病预防控制中心（CDC）每年对该厂工人进行职业健康检查，以尽早发现病损并及时处理。CDC进行的此项工作属于
A. 健康监护
B. 临床治疗
C. 职业卫生学现场调查
D. 病因预防
E. 预防性职业卫生监督

正确答案：A。健康监护

解析：CDC对经常接触职业性有害因素的工人进行职业健康检查，以尽早发现病损并及时处理。属于健康监护（A对）。病因预防（D错），是从根本上消除或控制职业性有害因素对人的作用和损害，即改革生产工艺和生产设备，合理利用防护设施及个人防护用品，以减少或消除工人接触的机会。